判断肺结核传染性最主要的依据是
A. 血沉增快
B. 胸部X线片显示空洞性病变
C. 结核菌素试验阳性
D. 痰涂片找到抗酸杆菌
E. 反复痰中带血

正确答案：D。痰涂片找到抗酸杆菌

解析：肺结核的传播途径以空气传播为主，肺结核患者咳嗽、喷嚏排出的结核杆菌悬浮在飞沫中播散，健康人吸入可致感染；痰干燥结核杆菌随尘埃吸入也可感染（8版传染病学P212），因此，痰涂片找到抗酸杆菌是判断肺结核具有传染性最主要的依据（D对）。肺结核患者血沉增快（A错），是肺结核活动性的表现，但无特异性，更不能说明结核病的传染性。胸部X线片（B错）显示空洞性病变是诊断肺结核的重要手段，有助于对病变部位、范围、性质、演变情况和治疗效果作出判断，但不能提示是否具有传染性。结核菌素试验（C错）是鉴定人体是否感染结核杆菌和感染反应程度的重要手段并不能说明肺结核是否具有传染性。反复痰中带血（E错）是肺结核的常见可疑症状，当炎症累及毛细血管时，可有小量咯血或痰中带血，也不能说明肺结核具有传染性。